电磁辐射中波长最长的频段是
A. 紫外线
B. 红外线
C. 高频电磁场
D. 无线电波
E. 微波

正确答案：D。无线电波